大剂量可干扰心肌细胞K⁺通道，引发致死性尖端扭转型室性心动过速的H₁受体拮抗剂是
A. 富马酸酮替芬
B. 阿司咪唑
C. 盐酸赛庚啶
D. 氯雷他定
E. 咪唑斯汀

正确答案：B。阿司咪唑